下列关于癌症的营养防治措施不正确的是
A. 在正常体重范围内尽可能瘦
B. 限制摄入高能量密度的食物
C. 高剂量营养素补充剂预防癌症
D. 母亲对婴儿最好进行6个月的完全母乳喂养
E. 限制红肉摄入，避免加工的肉制品

正确答案：C。高剂量营养素补充剂预防癌症